慢性复发性腮腺炎若挤压患侧腺体，导管口流出的液体为
A. 絮状唾液
B. 少量黏稠而有咸味液体
C. 胶冻状液体
D. 黏稠脓性分泌物
E. 含有“硫磺颗粒”的脓液

正确答案：C。胶冻状液体

解析：慢性复发性腮腺炎挤压腺体流出胶冻状液体。掌握“坏死性唾液腺化生与舍格伦综合征”知识点。